男性，46岁。左上后牙进食冷热饮食和咬硬物时疼痛1个月余。无自发痛史。口腔检查：左上6探诊牙体未见明显龋坏，温度刺激试验酸痛，刺激去除后即刻消失，叩诊（+），不松动。牙周检查（-）。近中沟似有裂纹。X线牙片示：根尖无异常。为确定诊断还应做哪项检查
A. 透照法
B. 牙髓活力电测试
C. 染色剂染色
D. 薄蜡片咬诊
E. 以上均应做

正确答案：C。染色剂染色

解析：本题考查牙隐裂的诊断。男性，46岁。左上后牙进食冷热饮食和咬硬物时疼痛1个月余。无自发痛史。口腔检查：左上6探诊牙体未见明显龋坏，温度刺激试验酸痛，刺激去除后即刻消失，叩诊（+），不松动。牙周检查（-）。近中沟似有裂纹。X线牙片示：根尖无异常。为确定诊断还应做染色剂染色（C对）。患者左上后牙有激发痛、咬合痛，无自发痛史，牙体未见明显龋坏，近中沟似有裂纹，考虑该患者左上6可能为牙隐裂。染色剂染色有助于裂线的发现，可用于牙隐裂的诊断。透照法对检查前牙邻面龋洞甚为有效（A错）。牙髓活力电测试是通过牙髓电活力测验仪来检测牙髓神经成分对电刺激的反应，主要用于判断牙髓“生”或“死”的状态（B错）。薄蜡片咬诊可用于检查牙齿是否存在早接触点（D错）。